有调血脂作用，也有抗凝血、抗血栓和抗炎作用的药物是
A. 洛伐他汀
B. 吉非贝齐
C. 考来烯胺
D. 烟酸
E. 普罗布考

正确答案：B。吉非贝齐